干槽症的诊断标准不包括以下哪项
A. 拔牙后1～2d有剧烈疼痛
B. 可向耳颞部，下颌下区或头顶部放射
C. 拔牙窝内空虚
D. 拔牙窝内有腐败坏死的血凝块
E. 口腔内可有臭味

正确答案：A。拔牙后1～2d有剧烈疼痛

解析：干槽症的诊断标准为：拔牙3～4天后有剧烈疼痛，并且可向耳颞部、下颌区或头顶部放射，一般镇痛药物不能止痛；拔牙窝内空虚，或有腐败变性的血凝块，腐臭味强烈。掌握“牙拔除术并发症”知识点。